河豚毒素主要存在于河豚鱼的
A. 肌肉
B. 内脏
C. 肝、卵巢
D. 血液
E. 皮肤、血液

正确答案：C。肝、卵巢

解析：河豚中毒：河豚主要含河豚毒素，是一种神经毒素，主要存在鱼的内脏、生殖腺、血液、眼、腮、皮肤等部位，在春季繁殖季节其卵巢和鱼卵毒性最高、肝脏次之。进入人体后作用于周围神经及脑干中枢致神经呈麻痹状态。早期症状是口唇、舌、指尖发麻，眼睑下垂，不久即出现消化道症状，进而出现口唇、舌尖及肢端麻木、四肢无力或肌肉麻痹、共济失调等神经系统症状。重症者出现瘫痪、言语不清、发绀、呼吸困难、神志不清、休克，最后因呼吸、循环衰竭而死亡。掌握“食品安全”知识点。